螺旋板端向右排列多个疣状突起，末端4～9个开孔的药材是
A. 牡蛎
B. 海螵蛸
C. 桑螵蛸
D. 石决明
E. 珍珠母

正确答案：D。石决明

解析：本题考查的是石决明药材的性状特征。螺旋板端向右排列多个疣状突起，末端4～9个开孔的药材是石决明（D对）。石决明：【性状鉴别】药材杂色鲍呈长卵圆形，内面观略呈耳形。表面暗红色，有多数不规则的螺肋和细密生长线，螺旋部小，体螺部大，从螺旋部顶处开始向右排列有20余个疣状突起，末端6～9个开孔，孔口与壳面平。内面光滑，具珍珠样彩色光泽。壳较厚，质坚硬，不易破碎。气微，味微咸。牡蛎（A错）：【性状鉴别】药材长牡蛎呈长片状，背腹缘几平行。右壳较小，鳞片坚厚，层状或层纹状排列。壳外面平坦或具数个凹陷，淡紫色、灰白色或黄褐色；内面瓷白色，壳顶两侧无小齿。左壳凹陷深，鳞片较右壳粗大，壳顶附着面小。质硬，断面层状，洁白。气微，味微咸。海螵蛸（B错）：【性状鉴别】药材无针乌贼呈扁长椭圆形，中间厚，边缘薄。背面有瓷白色脊状隆起，两侧略显微红色，有不甚明显的细小疣点状突起；腹面白色，自尾端到中部有细密波状横层纹；角质缘半透明，尾部较宽平，无骨针。体轻，质松，易折断，断面粉质，显疏松层纹。气微腥，味微咸。桑螵蛸（C错）：【性状鉴别】药材团螵蛸略呈圆柱形或半球形，由多层膜状薄片叠成。表面浅黄褐色，上面带状隆起不明显，底面平坦或有凹沟。体轻，质松而韧，横断面可见外层为海绵状，内层为许多放射状排列的小室，室内各有一细小椭圆形卵，深棕色，有光泽。气微腥，味淡或微咸。珍珠母（E错）为贝壳类中药，其性状鉴别2022年考试指南未明确说明。